下列哪项不是病毒性肝炎的防治措施
A. 管理传染源
B. 切开传播途径
C. 保护易感人群
D. 早发现、早隔离
E. 乙肝患者不得从事直接为顾客服务的工作

正确答案：E。乙肝患者不得从事直接为顾客服务的工作